依据《精神卫生法》，绐予吊销精神科医师执业证书处罚的情形是
A. 未及时对有伤害自身危险的患者进行检查评估的
B. 精神障碍患者对再次诊断结论有异议的
C. 故意将非精神障碍患者诊断为精神障碍患者的
D. 对实施住院治疗的患者未根据评估结果作出处理的
E. 拒绝对送诊的疑似精神障碍患者作出诊断的

正确答案：C。故意将非精神障碍患者诊断为精神障碍患者的

解析：依据《精神卫生法》，绐予吊销精神科医师执业证书处罚的情形有：①违反规定实施约束、隔离等保护性医疗措施的；②违反规定强迫精神障碍患者劳动的；③违反规定对精神障碍患者实施外科手术或者实验性临床医疗的；④违反规定侵害精神障碍患者的通讯和会见探访者等权利的；⑤违反精神障碍诊断标准，故意将非精神障碍患者诊断为精神障碍患者的（C对）。情节严重的，对直接负责的主管人员和其它直接负责人员依法给予或者责令给予降低岗位等级或者撤职、开除的处分，并可以责令有关医务人员暂停1个月以上6个月以下执业活动：①拒绝对送诊的疑似精神障碍患者作出诊断的（E错）；②对依照规定实施住院治疗的患者未及时进行检查评估（A错）或者根据评估结果未作出处理的（D错）（四版卫生法P303）。精神障碍患者对再次诊断结论有异议的（B错），可以自主委托依法取得执业资质的鉴定机构进行精神障碍医学鉴定，医疗机构应当公示经公告的鉴定机构名单和联系方式，接受委托的鉴定机构应当指定二名以上鉴定人共同进行鉴定，并及时出具鉴定报告。